一男性，某省厅干部，平时不嗜烟酒，生活规律；但性情急躁，易激动，工作认真，争强好胜，雄心勃勃。1年前单位减员时调人某厂工作，常因小事上火，发脾气。3日前因心绞痛人院，诊断为冠心病。发病的明显原因是
A. 物理性因素
B. 化学性因素
C. 生物性因素
D. 心理社会因素
E. 以上都是

正确答案：D。心理社会因素